11个月婴儿，夜惊，多汗，出牙4颗，方颅，前囟2cm×2cm，串珠肋，血钙2mmol/L（8mg/dl），钙磷乘积25，在门诊使用维生素D及钙剂正规治疗2个月，患儿症状明显好转，此时摄腕骨X线片，可能出现哪种表现
A. X线正常
B. 干骺端增宽，临时钙化带消失
C. 临时钙化带重新出现
D. 长骨短粗和弯曲，干骺端变宽呈喇叭状
E. 骨骺线检查正常，但可见弯曲畸形

正确答案：C。临时钙化带重新出现

解析：恢复期，经适当治疗后患儿临床症状减轻至消失，精神活泼，肌张力恢复。血清钙磷浓度数天内恢复正常，钙磷乘积亦渐正常，碱性磷酸酶4～6周恢复正常。X线表现于2～3周后即有改善，临时钙化带重新出现，逐渐致密并增宽，骨质密度增浓，逐步恢复正常。掌握“维生素D缺乏性佝偻病”知识点。